晚期产后出血感染邪毒证治疗方剂为
A. 补中益气汤
B. 生化汤合失笑散
C. 保阴煎
D. 五味消毒饮合失笑散
E. 归脾汤

正确答案：D。五味消毒饮合失笑散

解析：晚期产后出血感染邪毒证的病机是邪毒结聚，血行受阻，血不循经；治宜清热解毒，活血化瘀，方选清热解毒的五味消毒饮合活血祛瘀的失笑散（D对）。补中益气汤主治晚期产后出血气虚证（A错）；生化汤合失笑散（B错）主治晚期产后出血的血瘀证；保阴煎（C错）主治晚期产后出血的血热证；归脾汤（E错）主治脾不统血之崩漏。